男性，36岁，婚后2年有性生活，未避孕。既往有睾丸外伤史，免疫学检查出精液抗精子抗体（+）。问抗精子抗体产生的机制是
A. 抗原抗体交叉反应
B. B细胞克隆抗体
C. 隐蔽性抗原释放
D. 表面抗原扩展
E. 自身抗原反应

正确答案：C。隐蔽性抗原释放

解析：隐蔽抗原是指某些与免疫系统在解剖位置上隔绝的抗原成分，如精子、眼内容物等。手术、外伤、感染等因素破坏隔绝屏障，隐蔽抗原释放入血流或淋巴液，与免疫系统接触，引发自身免疫应答，导致自身免疫性疾病的发生（C对）。